下列哪一条是病例对照研究的优点
A. 可同时研究一种可疑因素与多种疾病的联系
B. 适用于常见病的病因研究
C. 样本小，省人力、物力，获得结果快
D. 偏倚少，结果可靠
E. 可计算发病率

正确答案：C。样本小，省人力、物力，获得结果快

解析：本题考查病例对照研究的优点。病例对照研究的优点为：①特别适用于罕见病、潜伏期长疾病的病因研究，有时往往是罕见病病因研究的唯一选择；②相对更节省人力、物力、财力和时间（C对ABDE错），并且较易于组织实施；③可以同时研究多个暴露与某种疾病的联系，特别适合于探索性病因研究；④该方法应用范围广，不仅应用于病因的探讨，而且广泛应用于其他健康事件的原因分析。